属于非特异性免疫的是
A. 致敏T淋巴细胞
B. IgG抗体
C. IgM抗体
D. IgE抗体
E. 单核-巨噬细胞

正确答案：E。单核-巨噬细胞

解析：单核巨噬细胞（E对）可以吞噬大多数的外源性物质，没有特异性。IgG、IgM、IgE（BCD错）都属于B细胞活化，分泌出的抗体，属于特异性的体液免疫，具有高度的特异性。致敏T淋巴细胞（A错）只对特异性的物质产生致敏作用。